男，72岁。排便时突然跌倒，意识丧失，呼吸断续，有陈旧心肌梗死和糖尿病病史，无高血压病史，诊断为心脏骤停。该患者既往超声心动图检查未发现异常，其心脏骤停最可能的病因是
A. 冠心病
B. 预激综合症
C. 主动脉瓣狭窄
D. 梗阻性肥厚型心肌病
E. 主动脉夹层

正确答案：A。冠心病

解析：患者老年男性，有陈旧心肌梗死和糖尿病病史，既往超声心动图检查未发现异常，故其心脏骤停最可能的病因是冠心病（A对）。预激综合征（P194）（B错）多伴有心动过速表现，一般不会引起心脏骤停。主动脉瓣狭窄（P296）（C错）、梗阻性肥厚型心肌病（P266）（D错）和主动脉夹层（P325）（E错）都会出现超声心动图的异常改变。